按发生的先后顺序记录主要症状的部位、性质等情况的属于
A. 发病情况
B. 伴随症状
C. 发病以来诊治经过及结果
D. 发病以来一般情况
E. 主要症状特点及其发展变化情况

正确答案：E。主要症状特点及其发展变化情况

解析：主要症状特点及其发展变化情况：按发生的先后顺序描述主要症状的部位、性质、持续时间、程度、缓解或加剧因素，以及演变发展情况。掌握“口外病史记录”知识点。